下列药物中，不宜与藜芦配伍的是
A. 黄芩
B. 黄连
C. 黄柏
D. 龙胆草
E. 苦参

正确答案：E。苦参

解析：该题考查中药的使用禁忌，属记忆内容。藜芦反人参、丹参、玄参、沙参、苦参、细辛、芍药。（E对ABCD错）。